患者意识障碍，可唤醒，但不能准确辨别人物和地点。该种意识状态
A. 浅昏迷
B. 谵妄
C. 意识模糊
D. 昏睡
E. 嗜睡

正确答案：C。意识模糊

解析：意识模糊是指意识水平轻度下降，较嗜睡为深的一种意识障碍，患者能保持简单的精神活动，但对时间、地点、人物的定向能力发生障碍（C对）。谵妄状态的患者在意识清晰度降低的同时出现大量的幻觉、错觉（B错）。昏睡的患者意识程度较意识模糊更低，表现为周围环境定向力和自我定向力均丧失，与本例不符（D错）。嗜睡表现为患者在安静环境中经常昏昏入睡，但给予刺激后可以立即醒转，并能进行简单应答，但停止刺激后患者又进入睡眠状态（E错）。